6个月以下小儿免疫预防接种不包括
A. 乙肝疫苗
B. 卡介苗
C. 麻疹疫苗
D. 百白破疫苗
E. 脊髓灰质炎疫苗

正确答案：C。麻疹疫苗

解析：乙肝疫苗（A对）出生时、1个月、6个月按计划接种；卡介苗（B对）出生时接种；百白破疫苗（D对）在3个月，4个月，5个月时接种；脊髓灰质炎疫苗（E对）在2个月、3个月、4个月接种；而麻疹疫苗（C错，为本题正确答案）在8个月初种，6岁复种。